队列研究属于
A. 流行病学的观察法
B. 流行病学的实验法
C. 流行病学的理论与方法学研究
D. 统计分析法
E. 基础实验法

正确答案：A。流行病学的观察法

解析：本题考查队列研究的特点。队列研究的基本特点为：1.属于观察法（A对BCDE错），队列研究中的暴露不是人为给予的，而是在研究之前已经客观存在的，不受研究者意志决定的；2.设立对照组；3.由因及果；4.检验暴露与结局的因果关系能力较强。